有关哌替啶药理作用错误的是
A. 激动μ型阿片受体
B. 作用持续时间较短
C. 易引起便秘和尿潴留
D. 大剂量可引起支气管平滑肌收缩
E. 有轻微的子宫兴奋作用

正确答案：C。易引起便秘和尿潴留

解析：哌替啶主要激动μ型阿片受体，药理作用与吗啡基本相同，作用持续时间较短。镇静、呼吸抑制、致欣快和扩血管作用与吗啡相当。本品也能提高平滑肌和括约肌的张力。但较少引起便秘和尿潴留。大剂量哌替啶也可引起支气管平滑肌收缩，无明显中枢性镇咳作用；有轻微的子宫兴奋作用，但不延缓产程。掌握“吗啡、哌替啶”知识点。